麻醉药品处方与普通药品处方的区别是
A. 应书写完整，字迹清楚
B. 应严格核对调配
C. 应有处方医师签名
D. 应写患者本人的真实姓名
E. 麻醉药品处方应增加“诊断”项

正确答案：E。麻醉药品处方应增加“诊断”项

解析：本题考查麻醉药品处方与普通处方的区别。麻醉药品处方与普通处方的区别是麻醉药品处方应增加“诊断”项（E对）。字迹清楚（A错）、应严格核对调配（B错）、应有处方医师签名（C错）、应写患者本人的真实姓名（D错）这四项为所有的处方都必须具备的内容。